龈切除手术后，塞治剂拆除时间一般是
A. 1～4天
B. 5～7天
C. 7～8天
D. 10～12天
E. 14～15天

正确答案：B。5～7天

解析：本题考查牙龈切除术。龈切除手术后，塞治剂拆除时间一般是5～7天（B对）。牙龈切除术是用手术方法切除增生肥大的牙龈组织或后牙某些部位的中等深度牙周袋，重建牙龈的生理外形及正常的龈沟。龈切除手术后，塞治剂拆除时间一般为5～7天。